构成乳糜池的淋巴干是下列哪组
A. 左、右肠干
B. 左、右腰干
C. 左、右肠干和腰干
D. 左、右腰干和肠干
E. 左肠干、左腰干

正确答案：D。左、右腰干和肠干

解析：左、右腰干和肠干（D对）为构成乳糜池的淋巴干。